张某因听力下降，决定去某药品零售企业购买一台助听器。选购时发现不同助听器的注册证号具有不同的格式：国械注进2015246××××号，沪食药监械（准）2012第246××××，京药监械（准）2012第246××××等，为此专门请教该药品零售企业值班药师，并购买了其中一款，使用两天后，张某发现该助听器存在质量问题，遂到该药店要求退货。根据上述材料的注册证号格式可以推断出助听器是第二类医疗器械。关于这类医疗器械的管理方式的说法，正确的是
A. 产品实行备案管理，经营实行备案管理
B. 产品实行注册管理，经营实行备案管理
C. 产品实行备案管理，经营实行许可管理
D. 产品实行注册管理，经营实行许可管理

正确答案：B。产品实行注册管理，经营实行备案管理

解析：本题考查医疗器械的产品注册与备案管理。张某因听力下降，决定去某药品零售企业购买一台助听器。选购时发现不同助听器的注册证号具有不同的格式：国械注进2015246××××号，沪食药监械（准）2012第246××××，京药监械（准）2012第246××××等，为此专门请教该药品零售企业值班药师，并购买了其中一款，使用两天后，张某发现该助听器存在质量问题，遂到该药店要求退货。根据上述材料的注册证号格式可以推断出助听器是第二类医疗器械。关于这类医疗器械的管理方式的说法，正确的是产品实行注册管理，经营实行备案管理（B对）。医疗器械的产品注册与备案管理：第一类医疗器械实行产品备案管理（AC错）。第二类、第三类医疗器械实行产品注册管理。医疗器械经营分类管理要求：按照医疗器械风险程度，医疗器械经营实施分类管理。经营第一类医疗器械不需许可和备案，经营第二类医疗器械实行备案管理，经营第三类医疗器械实行许可管理（D错）。